硫喷妥钠在体内经脱硫代谢生成
A. 苯巴比妥
B. 异戊巴比妥
C. 司可巴比妥
D. 巴比妥酸
E. 戊巴比妥

正确答案：E。戊巴比妥